气不摄血可致
A. 气脱
B. 血瘀
C. 出血
D. 血热
E. 气陷

正确答案：C。出血

解析：本题考查的是气不摄血证的临床表现及辨证要点。气不摄血可致出血（C对）。气血同病常见证候的临床表现及辨证要点：气为阳，血为阴。气与血有阴阳相随、互为依存的关系，故气血变化的互相影响，在临床上非常多见。气血同病证候，常见气滞血瘀、气血两虚、气不摄血、气随血脱证等。1.气滞血瘀证的临床表现及辨证要点：气滞血瘀证的临床表现，常见胸胁胀满走窜疼痛，性情急躁，并兼见痞块刺痛拒按，舌紫暗或有瘀斑等。妇女还可见月经闭止，或痛经、经色紫暗有块，乳房胀痛等症状。一般以病程较长和肝经循行部位的疼痛痞块为辨证要点。2.气血两虚证的临床表现及辨证要点：气血两虚证的临床表现，常见少气懒言，乏力自汗，面色苍白或萎黄，心悸失眠，舌淡而嫩，脉细弱等。多以气虚与血虚的症状同见为辨证要点。3.气不摄血证的临床表现及辨证要点：气不摄血证的临床表现，常见出血的同时，见有气短，倦怠乏力，面色苍白，脉软弱细微、舌淡等气虚的症状。多以出血和气虚症状同见为辨证要点，脾有统摄血液在脉中运行和运化水谷精微的功能，所以气不摄血证，也常见到脾虚的症状。4.气随血脱证的临床表现及辨证要点：气随血脱证的临床表现，常见于大量出血的同时，见面色白，四肢厥冷，大汗淋漓，甚至晕厥，脉微细或弱等症。多以大量出血时，随即出现气脱（A错）的症状为辨证要点。血瘀（B错）证的临床表现及辨证要点：血瘀证的临床表现，常见局部肿胀疼痛，痛如针刺，拒按，痛处固定不移，且常在夜间加重，一般伴有面色晦暗、口唇色紫、舌有瘀斑、口干但欲漱水不欲咽等症状。一般以痛如针刺，痛有定处、拒按、肿块、唇舌爪甲紫暗、脉涩等为辨证要点。血热（D错）证的临床表现及辨证要点：血热证的临床表现，常见心烦，或躁扰发狂，口干不喜饮，身热，以夜间为甚，脉细数，舌红绛，或见各种出血证，妇女月经先期、量多等。一般以出血和全身热象为辨证要点。气陷（E错）证的临床表现及辨证要点：气陷证的临床表现，常见头目昏花，少气倦怠，腹部有坠胀感，脱肛或子宫脱垂等，舌淡苔白，脉弱。一般以内脏下垂为主要诊断要点。